边缘叶的功能是
A. 内脏活动区
B. 听觉区
C. 躯体运动区
D. 视觉区
E. 躯体感觉区

正确答案：A。内脏活动区

解析：位于边缘叶的皮质区存在呼吸、血压、瞳孔、胃肠和膀胱等各种内脏活动的代表区，因而边缘叶的功能是内脏活动区（A对）。听觉区（B错）位于颞横回。躯体运动区（C错）位于中央前回和中央旁小叶前部。视觉区（D错）位于距状沟上、下方的枕叶皮质。躯体感觉区（E错）位于中央后回和中央旁小叶后部。